典型的胃溃疡症状是
A. 进行性吞咽困难
B. 进餐后上腹痛，至下一餐前缓解
C. 不洁饮食后上腹痛，伴呕吐腹泻
D. 空腹及夜间上腹痛，进食后可缓解
E. 反酸、烧心，伴胸骨后烧灼样痛

正确答案：B。进餐后上腹痛，至下一餐前缓解

解析：胃溃疡患者腹痛常因进食刺激胃酸分泌而引起，表现为餐后痛，1～2个小时逐渐缓解（B对）。进行性吞咽困难（A错）是典型的食管癌的症状。不洁饮食后上腹痛，伴呕吐腹泻（C错）是典型的肠胃炎的症状。空腹及夜间上腹痛，进食后可缓解（D错）是典型的十二指肠溃疡症状。反酸烧心伴胸骨后烧灼样痛（E错）是典型的胃食管反流症状。